下列对矿物质生理功能描述错误的是
A. 供给能量
B. 构成人体组织的重要成分
C. 调节细胞膜的通透性
D. 维持神经和肌肉的兴奋性
E. 组成激素、酶的成分

正确答案：A。供给能量